按照《献血法》的规定，表述错误的是
A. 血站是采集提供临床用血的机构
B. 血站是不以营利为目的的公益性组织
C. 血站应当义务无偿为患者提供血液
D. 设立血站必须经省级以上人民政府卫生行政部门批准
E. 血站的管理办法由国务院卫生行政部门制定

正确答案：C。血站应当义务无偿为患者提供血液

解析：根据《中华人民共和国献血法》规定，公民临床用血时，需要交付血站采集、分离、储存、检验血液费用及临床输血服务费等，血站应当义务无偿为患者提供血液（C错，为本题正确答案）的说法错误。按照《献血法》规定，血站是指采集提供临床用血的机构（A对），血站是不以营利为目的的公益性组织（B对）。设立血站必须经省级以上人民政府卫生行政部门批准（D对）。血站的管理办法由国务院卫生行政部门制定（E对）。